睡前应由母亲手指缠上清洁纱布或用乳胶指套擦洗牙龈和腭部的是
A. 婴儿
B. 幼儿
C. 学龄儿童
D. 青壮年
E. 老年人

正确答案：A。婴儿

解析：本题考查婴幼儿口腔保健内容和方法-建立良好口腔清洁习惯。睡前应由母亲手指缠上清洁纱布或用乳胶指套擦洗牙龈和腭部的是婴儿（A对）。1.出生后～6个月：出生后即应建立口腔清洁习惯。牙萌出前，应建立每日为婴儿清洁口腔的习惯，在哺乳后或晚上睡前用手指缠上清洁纱布为儿童清洁口腔。6个月左右第一颗乳牙萌出后，可用手指缠上柔软干净纱布，蘸清水轻轻擦洗牙面。2.6个月～1岁：牙萌出后，家长仍可以用手指缠上清洁干净纱布，蘸清水为孩子擦洗牙面，配合使用乳胶指套擦洗牙龈和腭部，清除黏附的食物残渣，按摩牙床，并使婴儿逐渐适应每日的口腔护理。还可使用硅胶制成的牙齿训练器，清洁消毒后让婴儿放在口中咀嚼，促进颌骨和牙床发育。3.1～3岁：提倡开始刷牙去除菌斑。